能导致ARDS的是
A. 一氧化碳
B. 氯气
C. 氰化氢
D. 二氧化氮

正确答案：B。氯气

解析：本题考查氯气中毒引发的症状。当出现氯气（B对ACD错）的急性重度中毒时，会引发呼吸系统的严重疾病，包括弥漫性肺泡性肺水肿或中央性肺泡性肺水肿；严重者出现急性呼吸窘迫综合征；还可引起声门痉挛或水肿导致迅速窒息死亡或心脏停搏所致猝死；严重者可合并气胸或纵隔气肿等。